医务人员收受药品生产企业的财物，情节尚不严重时，依法应对其给予的处罚是
A. 没收违法所得
B. 罚款
C. 吊销执业证书
D. 追究刑事责任
E. 警告

正确答案：A。没收违法所得

解析：医疗机构的负责人、药品采购人员、医师等有关人员收受药品生产企业、药品经营企业或者其代理人给予的财物或者其他利益的，由卫生行政部门或者本单位给予处分，没收违法所得（A对）；对违法行为情节严重的执业医师，由卫生行政部门吊销其执业证书（C错）；构成犯罪的，依法追究刑事责任（D错）。